主要有效成分为蒽醌类的是
A. 虎杖
B. 洋金花
C. 麻黄
D. 补骨脂
E. 柴胡

正确答案：A。虎杖

解析：本题考查的是虎杖的化学成分。主要有效成分为蒽醌类的是虎杖（A对）。虎杖主要含有蒽醌类化合物。蒽醌类成分包括大黄素、大黄酚、大黄酸等。此外，还含有非蒽醌类的化合物如虎杖苷等。《中国药典》采用高效液相色谱法测定药材中大黄素和虎杖苷的含量，大黄素不得少于0.60%，虎杖苷不得少于0.15%。洋金花（B错）主要化学成分为莨菪烷类生物碱，由莨菪醇类和芳香族有机酸结合生成的一元酯类化合物。主要有莨菪碱（阿托品）、山莨菪碱、东莨菪碱、樟柳碱和N-去甲莨菪碱。《中国药典》以东莨菪碱为指标成分进行含量测定，要求东莨菪碱不得少于0.15%。麻黄（C错）中含有多种生物碱，以麻黄碱和伪麻黄碱为主，前者占总生物碱的40%～90%，《中国药典》以盐酸麻黄碱和盐酸伪麻黄碱为指标成分进行含量测定，要求药材和饮片含盐酸麻黄碱和盐酸伪麻黄碱的总量不得少于0.80%。此外麻黄还含少量的甲基麻黄碱、甲基伪麻黄碱和去甲基麻黄碱、去甲基伪麻黄碱。补骨脂（D错）补骨脂含有多种香豆素类成分，包括补骨脂内酯（补骨脂素）、异补骨脂内酯（异补骨脂素）和补骨脂次素等。《中国药典》采用高效液相色谱法测定药材中补骨脂素和异补骨脂素含量，两者总含量不得少于0.70%。柴胡（E错）中含有的总皂苷为1.6%～3.8%。柴胡中所含皂苷均为三萜皂苷，柴胡皂苷是柴胡的主要有效成分。《中国药典》以柴胡皂苷a和柴胡皂苷d为指标成分对柴胡药材进行含量测定。要求两者的总含量不少于0.30%。